关于牙周膜中的血管的分布，下列说法正确的是
A. 前牙的牙周膜血管比后牙的丰富
B. 下颌的牙周膜血管比上颌的丰富
C. 上颌前牙的牙周膜血管最丰富
D. 上颌后牙的牙周膜血管最丰富
E. 下颌前牙的牙周膜血管最丰富

正确答案：B。下颌的牙周膜血管比上颌的丰富

解析：牙周膜血管分布因牙而异，后牙的牙周膜血管比前牙丰富，下颌牙比上颌牙丰富。故下颌后牙牙周膜的血管分布是最丰富的。掌握“牙周膜”知识点。